肝气不和、气机壅滞便秘的主要症状有
A. 大便数日一行
B. 便时涩滞不爽
C. 腹胀满闷
D. 矢气则快
E. 胁肋时胀

正确答案：A、B、C、D、E。大便数日一行；便时涩滞不爽；腹胀满闷；矢气则快；胁肋时胀